混合易发生爆炸的是
A. 维生素C和烟酰胺
B. 生物碱与鞣酸
C. 乳酸环丙沙星与甲硝唑
D. 碳酸氢钠与大黄酚
E. 高锰酸钾与甘油

正确答案：E。高锰酸钾与甘油

解析：本题考查药物的配伍变化。混合易发生爆炸的是高锰酸钾和甘油（E对）。配伍变化可分为物理的、化学的和药理的三个方面，其中化学的配伍变化包括（1）变色。维生素C和烟酰胺，碳酸氢钠与大黄酚。（2）浑浊或沉淀。①pH改变产生沉淀。②水解产生沉淀。③生物碱盐溶液的沉淀。④复分解产生沉淀。（3）产气。（4）分解破坏、疗效下降。乳酸环丙沙星与甲硝唑。（5）发生爆炸。高锰酸钾与甘油。